女性，26岁。因甲状腺癌行甲状腺全切除术，术后当晚出现呼吸困难，伤口肿胀有血液渗出。最佳急救处理为
A. 气管切开
B. 气管插管
C. 面罩吸氧
D. 静注地塞米松
E. 拆除缝线，敞开手术创腔

正确答案：E。拆除缝线，敞开手术创腔

解析：患者接受甲状腺手术后，当晚出现出现呼吸困难，伤口肿胀有血液渗出，考虑切口内出血，形成血肿压迫气管，此时最佳急救处理为拆除缝线，敞开手术创腔（E对），迅速去除血肿以解除对气管的压迫。若进行上述操作后，病人呼吸仍无改善，则应立即行气管插管（B错），插管失败则改行床旁气管切开（A错）。呼吸道梗阻未解除时，面罩吸氧（C错）无法有效改善呼吸状态。静注地塞米松（D错）为术后甲状腺危象的治疗措施之一，但对呼吸困难无治疗作用。